买卖进出口证明文件，情节严重的，构成
A. 虚假广告罪
B. 销售劣药罪
C. 销售假药罪
D. 生产假药罪
E. 非法经营罪

正确答案：E。非法经营罪

解析：本题考查非法经营罪。《中华人民共和国刑法》第二百二十五条 违反国家规定，有下列非法经营行为（E对）之一，扰乱市场秩序，情节严重的，处五年以下有期徒刑或者拘役，并处或者单处违法所得一倍以上五倍以下罚金；情节特别严重的，处五年以上有期徒刑，并处违法所得一倍以上五倍以下罚金或者没收财产：（一）未经许可经营法律、行政法规规定的专营、专卖物品或者其他限制买卖的物品的；（二）买卖进出口许可证、进出口原产地证明以及其他法律、行政法规规定的经营许可证或者批准文件的；（三）未经国家有关主管部门批准非法经营证券、期货、保险业务的，或者非法从事资金支付结算业务的；（四）其他严重扰乱市场秩序的非法经营行为。